下列关于恶性淋巴瘤的叙述中，不正确的是
A. 可发生于任何年龄组
B. 以颈部淋巴结最好发
C. 发生于淋巴结者称结内型
D. 我国的恶性淋巴瘤中大多属结外型
E. 以外科手术治疗为主

正确答案：E。以外科手术治疗为主

解析：恶性淋巴瘤对放射治疗和化学药物治疗都比较敏感。掌握“恶性淋巴瘤”知识点。